选择固定桥基牙时，临床冠根比的最低限度是
A. 1：1
B. 1：2
C. 2：3
D. 3：2
E. 3：4

正确答案：A。1：1

解析：本题考查基牙的选择-冠根比。选择固定桥基牙时，理想的冠根比应为2：3～1：2，最小1：1（A对），才能保证良好的预后。如果基牙牙根过短，牙冠受力过大时易对基牙造成损伤。